患者身热汗出，心烦口渴，体倦少气，小便短赤，脉虚数治宜选用
A. 清暑益气汤
B. 生脉散
C. 银翘散
D. 白虎汤
E. 香薷散

正确答案：A。清暑益气汤

解析：“身热汗出，心烦口渴，体倦少气，小便短赤，脉虚数”是暑热气津两伤证的证候表现。暑为阳邪，其性炎热，暑热伤人则身热；暑性升散，使腠理开泄，邪热迫津外泄，故见汗出；暑气通心，暑热扰心则心烦；暑易伤津耗气，故见口渴，小便短赤，体倦少气，脉虚数。方选清暑益气汤（A对），方中以西洋参益气生津，养阴清热，合西瓜翠衣清热解暑，共为君药。荷梗解暑清热，又可理气宽胸；石斛、麦冬助西洋参养阴生津，共为臣药。黄连苦寒，其功专于泻火，以助清热祛暑之力。知母苦寒质润，滋阴泻火；竹叶清热除烦，为佐药。甘草、粳米益胃和中，为使药。诸药合用，共奏清暑益气、养阴生津之效。